南方某村，居民以玉米为主食。某年秋天突然有10余人出现发热、呕吐、厌食、黄疸，随后出现腹水、浮肿，因抢救及时未出现死亡病例。经医生诊断排除传染性肝炎，分析原因与居民主食玉米有关，该情况最可能是
A. 污水灌田引起玉米中镉超标
B. 玉米晾晒过程被多环芳烃污染
C. 玉米中有农药残留
D. 玉米被黄曲霉毒素污染
E. 玉米中混进了有毒植物种子

正确答案：D。玉米被黄曲霉毒素污染

解析：玉米、花生及其制品最易受到黄曲霉毒素（AF）污染，AF有很强的毒性，对肝脏有特殊亲和性，具有较强的肝脏毒性及致肝癌作用。题中居民以易受黄曲霉毒素污染的玉米为主食，且突然出现发热、呕吐、厌食、黄疸等肝损伤症状，因此该情况最可能是玉米被黄曲霉毒素污染（D对）。镉易污染稻米，常期食用“镉米”会产生“痛痛病”，症状主要为骨质疏松、关节疼痛（A错）。多环芳烃主要由煤炭、石油、木材等有机化合物的热解和不完全燃烧而产生，主要污染烘烤、油炸、烟熏食品，对人体的危害为致癌（B错）。农药种类繁多，中毒后临床症状各异，目前广泛使用的农药是有机磷农药，其中毒表现为毒蕈碱样、烟碱样和中枢神经系统症状，与本题症状不符（C错）。有毒植物种子种类同样繁多，中毒后症状各异，有毒植物种子中毒多有地区性，与玉米主食关系不大（E错）。